（牙合）检查时，咬蜡片常用于检查
A. 正中（牙合）
B. 前伸（牙合）
C. 侧方（牙合）
D. 反（牙合）
E. 以上都是

正确答案：A。正中（牙合）

解析：本题考查（牙合）检查的方法步骤。因蜡片质地软在正中垂直（牙合）力作用下会出现切要痕迹，因此（牙合）检查时，蜡片常用于检查正中（牙合）（A对），厚度均匀的薄型蜡片，烤软后放在被检查牙的（牙合）面，令患者作正中咬合，待蜡片冷却后取出，然后对光透照检查蜡片上的咬合印迹。若有菲薄透亮甚至穿孔区，即为早接触点。前伸（牙合）（B错）或侧向（牙合）（C错）的检查可用咬合纸法检查，而不用蜡片检查，因为咬合纸质地韧，在非垂直向磨切力大的前伸（牙合）和侧向（牙合）中不会穿透破损，而蜡片软而易被牙齿穿透所以主要用于垂直向的磨切力小的正中咬合的检查。反（牙合）（D错）不用咬合纸或蜡片检查，而是采用观察法，嘱患者作正中咬合观察下前牙是否位于上前牙的前方，若是则为反（牙合）。